某3岁幼儿，在急切的时候有口吃的表现，还出现抽鼻、跺脚等动作，此时家长应该
A. 着重心理疏导
B. 着重言语矫治
C. 立即表达自己的不满情绪
D. 对其忽视
E. 药物治疗

正确答案：A。着重心理疏导

解析：本题考查神经心理发育与行为发展的相关内容。幼儿语言迅速发展，但语言的表达往往落后于思维，所以容易发生生理性口吃，以及啃咬指甲、遗尿、口吃等表现是儿童时期常见一类心理卫生问题。这些表现一般在婴幼儿期出现，如在5岁以后仍然持续存在，要予以重视，给予必要的心理疏导（A对BCDE错）。儿童心理性问题的产生不仅与儿童自身神经系统的发育有关，还与其生活习惯的培养、生活环境状况等因素有关。